甲是药品零售连锁企业所属门店，经营类别：处方药、甲类非处方药、乙类非处方药，经营范围：第二类精神药品、生物制品、化学药、中成药、中药饮片。乙是药品零售企业，经营类别：处方药、甲类非处方药、乙类非处方药，经营范围：生物制品、化学药、中成药。丙是药品零售企业，经营类别：乙类非处方药，经营范围：生物制品、化学药、中成药。根据处方药与非处方药分类管理规定，结合题目提供的信息，下列做法正确的是
A. 甲在经营场所内开架销售中药饮片百合、枸杞子
B. 甲营业期间，一老人身体不适欲购买处方药速效救心丸，经询问发现老人有冠心病史，执业药师在没有处方的情况下，依然向其销售了该处方药，并建议其立即就诊
C. 乙建立处方药销售的处方管理制度，要求对售出的处方药处方进行抄录，处方原件返消费者
D. 乙的执业药师在凭处方向个人消费者销售处方药时，结合其表状的疾病症状，告知其该处方药与另一处方药联合购买可以享受优惠

正确答案：A。甲在经营场所内开架销售中药饮片百合、枸杞子

解析：本题考查的是药品零售企业不得经营的药品种类。甲是药品零售连锁企业所属门店，经营类别：处方药、甲类非处方药、乙类非处方药，经营范围：第二类精神药品、生物制品、化学药、中成药、中药饮片。乙是药品零售企业，经营类别：处方药、甲类非处方药、乙类非处方药，经营范围：生物制品、化学药、中成药。丙是药品零售企业，经营类别：乙类非处方药，经营范围：生物制品、化学药、中成药。根据处方药与非处方药分类管理规定，结合题目提供的信息，下列做法正确的是甲在经营场所内开架销售中药饮片百合、枸杞子（A对）。药品零售企业不得经营的药品：麻醉药品、放射性药品、第一类精神药品、终止妊娠药品（包括含有“米非司酮”成分的所有药品制剂）、蛋白同化制剂、肽类激素（胰岛素除外）、药品类易制毒化学品、疫苗，以及我国法律法规规定的其他禁止零售的药品。药品零售企业也不得经营中药配方颗粒、医疗机构制剂。零售企业销售处方应当按照国家处方药与非处方药分类管理有关规定，凭处方销售处方药（B错）。零售药店对处方必须留存2年以上备查（C错）。药品零售企业不得采用开架自选的方式销售处方药，也不得采用“捆绑搭售”（D错）“买商品赠药品”“买N赠1”“满N减1”“满N元减X元”等方式直接或变相赠送销售处方药、甲类非处方药（包括通过网络销售的渠道）。